患儿10岁，上前牙牙龈时常流脓1月余。查左上1远中舌面深龋，探无反应，无穿髓孔，牙松动Ⅰ度，叩（+），冷测无反应，唇侧牙龈近根尖处有一窦道。为确定诊断，临床需要作的检查是X线片，临床拟诊断为慢性根尖周炎，临床治疗应选择
A. 干髓术
B. 活髓切断术
C. 根管治疗术
D. 拔除
E. 塑化治疗

正确答案：C。根管治疗术

解析：本题考查慢性根尖周炎的治疗。根据病例描述，远中舌面深龋，探无反应，无穿髓孔，冷热测无反应，可知患牙牙髓已坏死；上前牙牙龈时常流脓1月余，松I度，叩痛（+），唇侧牙龈近根尖处有一窦道口，可知患牙牙髓炎症已蔓延到根尖周，导致根尖周炎症，综上所述，可初步诊断为慢性根尖周炎。慢性根尖周炎的治疗应该选择根管治疗术（C对），清除根管内感染物质，严密充填根管。干髓术（A错）是去除感染的冠髓，保留干尸化的根髓，不适用于根尖周炎的治疗。活髓切断术（B错）多用于根尖未发育完成的年轻恒牙，切除病变部分牙髓，保留感染未波及的部分牙髓，以保证牙根能够发育完成，该病例中牙髓已坏死，不能用活髓切除术。拔除（D错）适用于没有保留价值的牙，本病例中患牙牙周状况良好，不能拔除，应予保留。塑化治疗（E错）是用两型塑化液剂混合发生聚合反应，将根管内的炎性物质包裹起来使牙髓与根管壁整个隔开阻断了刺激，可以用于慢性根尖周炎的治疗，但是它们的效果不如根管治疗好，且因未去除根管内感染牙髓，一段时间后根尖发生感染的风险较高，后续处理困难，在临床上已极少使用。